促甲状腺肿物质是
A. 砷
B. 氟
C. 钙
D. 磷
E. 硫氰酸盐

正确答案：E。硫氰酸盐

解析：大量流行病学调查显示，缺碘并不是地方性甲状腺肿唯一发病原因，某些病区尚存在其他甲状腺肿物质，第一个就是有机硫化物，如硫氰化物---硫氰酸盐（E对）。砷中毒主要侵害神经系统、肝脏、肾脏和心血管系统（A错）。过量氟可以引起氟斑牙和氟骨症（B错）。钙为毒性最小的一类元素，无明显毒作用（C错）。磷过量对骨产生不良影响，还会引起非骨组织钙化（D错）。